在包制薄膜衣的过程中，所加入的二氧化钛是
A. 矫味剂
B. 遮光剂
C. 防腐剂
D. 增塑剂
E. 抗氧剂

正确答案：B。遮光剂

解析：本题考查片剂的包衣。遮光剂（B对）是一种可以吸收紫外线和防止紫外线穿透薄膜衣的物质，可以增加药物的光稳定性，二氧化钛常用作遮光剂；矫味剂（A错）是指药品中用以改善或屏蔽药物不良气味的物质；防腐剂（C错）是指具有抑菌作用，能抑制微生物生长繁殖的物质；增塑剂（D错）为改变高分子薄膜，增加其可塑性的物质；抗氧剂（E错）是指可以延缓或者抑制药物氧化的物质。